患者30岁，因治疗其它龋坏牙时，发现左下5（牙合）面中央有一圆形钝锥形突起，左上45右下45咬合关系正常，叩（-），冷热测同对照牙，该牙应如何处理
A. 不必治疗，定期观察
B. 备洞银汞充填
C. 备洞玻璃离子充填
D. 直接盖髓
E. 活髓切断

正确答案：A。不必治疗，定期观察

解析：本题考查畸形中央尖的治疗。患者30岁，因治疗其它龋坏牙时，发现左下5（牙合）面中央有一圆形钝锥形突起，左上45右下45咬合关系正常，叩（-），冷热测同对照牙，该牙应不必治疗，定期观察（A对）。畸形中央尖多见于下颌前磨牙，尤以第二前磨牙最多见，一般为位于（牙合）面中央窝处，呈圆锥状突起。根据病例描述，患者左下5（牙合）面中央有一圆形钝锥形突起，叩（-），冷热测同对照牙，可考虑左下5为畸形中央尖，左上45右下45咬合关系正常，不必治疗，定期观察即可。尖而长的中央尖容易折断或被磨损而露髓，可在局麻下，将此尖一次磨除，然后备洞，由于半数的中央尖有髓角伸入，备洞后一般都会露髓，不能直接充填（BC错），应进行直接盖髓治疗（D错）。活髓切断适用于根尖未发育完成的年轻恒牙，畸形中央尖折断露髓，可去除感染的牙髓，保留根髓，待根尖发育完成后再行根管治疗，患者30岁，根尖已发育完成，且无露髓情况，不需此治疗（E错）。